近年来，我国儿童、青少年肥胖率持续升高，最主要的原因是
A. 遗传因素
B. 儿童膳食中热能摄入超过消耗，体力活动减少
C. 中小学生课业负担过重
D. 社会经济水平提高
E. 社会保健水平提高

正确答案：B。儿童膳食中热能摄入超过消耗，体力活动减少